涂布麻醉指的是
A. 口腔颌面部软组织浸润麻醉
B. 骨膜上和黏膜下浸润麻醉
C. 阻滞麻醉
D. 冷冻麻醉
E. 表面麻醉

正确答案：E。表面麻醉

解析：表面麻醉亦称涂布麻醉，是将麻醉剂涂布或喷射于手术区表面，麻醉药物被吸收而使末梢神经麻痹，以达到镇痛效果的局部麻醉方法。掌握“颌面部常用局麻法及牙拔除的麻醉选择”知识点。